胃壁细胞分泌H⁺的方式是
A. 原发性转运
B. 继发性转运
C. 出胞作用
D. 单纯扩散
E. 易化扩散

正确答案：A。原发性转运

解析：某些物质的主动转运不直接来自ATP的分解，而是利用原发性主动转运机制建立起的Na+或 H+的浓度梯度，在 Na+或 H+离子顺浓度梯度扩散的同时使其他物质逆浓度梯度和（或）电位梯度跨膜转运，这种间接利用 ATP 能量的主动转运过程称为继发性主动转运 （B错）。出胞是指胞质内的大分子物质以分泌囊泡的形式排出细胞的过程，例如，外分泌腺细胞排放酶原颗粒和黏液、内分泌腺细胞分泌激素、神经纤维末梢释放神经递质等过程都属于出胞（C错）。单纯扩散是指物质从质膜的高浓度一侧通过脂质分子间隙向低浓度一侧进行的跨膜扩散，比如02 、CO2、N2、类固醇激素、乙醇、尿素、甘油、水等（D错）。易化扩散 是指非脂溶性的小分子物质或带电离子在跨膜蛋白帮助下，顺浓度梯度和（或）电位梯度进行的跨膜转运（E错）。